药物不良反应监测报告实行
A. 医师或临床药师报告制度
B. 临床药学室收集报告制度
C. 逐级定期报告制度
D. 通过互联网直接上报制度
E. 直接上报、逐级反馈制度

正确答案：C。逐级定期报告制度

解析：医疗机构获知或者发现可能与用药有关的不良反应，应当通过国家药品不良反应监测信息网络报告；不具备在线报告条件的，应当通过纸质报表报所在地不良反应监测机构，由所在地药品不良反应监测机构代为在线报告。报告内容应当真实、完整、准确。掌握“药品不良反应概念、报告、处置与法律责任”知识点。